某印染厂男工，45岁，工龄约10年。某日下班后突感到头痛、头晕、口唇及指端发绀，送急诊室就诊。应给予何种特效治疗药物
A. 硫代硫酸钠
B. 亚硝酸钠
C. 亚甲蓝
D. 4-DMAP
E. GSH

正确答案：C。亚甲蓝

解析：本题考查苯胺中毒的治疗。从事印染行业的工人，处于长期暴露于苯胺的状态。同时长期慢性接触苯胺可出现类神经症，如头晕、头痛等症状，并出现口唇、指端及耳垂等部位的化学性发绀症状，该工人的表现符合苯胺中毒的症状，为苯胺中毒。当苯胺等苯的氨基硝基化合物中毒时，常用亚甲蓝（C对ABDE错）这类高铁血红蛋白还原剂进行治疗。